下列各项中不符合慢性髓性白血病急变的是
A. 骨、关节痛
B. 脾缩小
C. 贫血、出血加重
D. 以往治疗无效
E. 发热经抗生素治疗可无效

正确答案：B。脾缩小